棕榈炭的功效是
A. 收敛止血
B. 凉血止血
C. 温经止血
D. 理气止血
E. 化瘀止血

正确答案：A。收敛止血

解析：本题考查棕榈炭的功效。棕榈炭的功效是收敛止血（A对）。棕榈炭【功效】收敛止血。马齿苋【功效】清热解毒，凉血止血（B错），通淋。艾叶【功效】温经止血（C错），散寒止痛。三七【功效】化瘀止血（E错），活血定痛。